下列属于正常细胞性贫血的是
A. 急性失血性贫血
B. 骨髓增生异常综合征
C. 缺铁性贫血
D. 慢性失血性贫血
E. 铁粒幼细胞性贫血

正确答案：A。急性失血性贫血

解析：贫血按照红细胞形态分大细胞性贫血、正常细胞性贫血和小细胞低色素性贫血。正常细胞性贫血的特点是红细胞平均体积80～100fl，红细胞平均血红蛋白浓度32%～35%。常见疾病有：急性失血性贫血（A对）、骨髓病性贫血等。骨髓增生异常综合征（B错）属于大细胞性贫血；缺铁性贫血（C错）、慢性失血性贫血（D错）、铁粒幼细胞贫血（E错）属于小细胞低色素性贫血。